在经皮给药制剂中，压敏胶的作用有
A. 帮助粘贴皮肤
B. 用作背衬材料
C. 作为药物贮库材料
D. 促进药物吸收
E. 调节药物的释放速率

正确答案：A、C、E。帮助粘贴皮肤；作为药物贮库材料；调节药物的释放速率

解析：本题考查压敏胶的作用。压敏胶指一类在轻微压力下（例如指压）即可实现粘贴（A对）同时又容易剥离的胶黏材料，起着保证释药面与皮肤紧密接触的作用，有时又作为药物的贮库（C对）或载体材料，用于调节药物的释放速率（E对）。